下列β受体阻断药中哪个兼有α受体阻断作用
A. 普萘洛尔
B. 美托洛尔
C. 拉贝洛尔
D. 噻吗洛尔
E. 吲哚洛尔

正确答案：C。拉贝洛尔